男，55岁。进行性吞咽困难三个月，体重下降5kg，目前能进半流食。进一步确诊的首选检查方式是
A. 胸部CT
B. 食管超声波检查
C. 食管拉网
D. 食管镜检查活检
E. 胸部MRI

正确答案：D。食管镜检查活检

解析：中年男性患者，进行性吞咽困难，3个月体重下降5kg（提示恶病质），结合患者病史和临床表现，对该病人最可能的诊断为食管癌。为明确诊断，首选检查方式是食管镜检查活检（D对），病理活组织检查是诊断金标准。胸部CT（A错）、食管超声波检查（B错）、胸部MRI（E错）均属于影像学检查方法，可协助诊断食管癌，但不能确诊。食管拉网（C错）为食管癌的筛查方法，一般不作为确诊首选。